处方书写穿山甲应付
A. 麸炒品
B. 烫制品
C. 煅制品
D. 炭制品

正确答案：B。烫制品

解析：本题考查饮片的处方应付。处方书写穿山甲应付烫制品（B对）。常见的处方应付实例：（1）处方直接写药名（或炒或炙），需调配烫制品，如龟甲、鳖甲、穿山甲等。（2）处方直接写药名（或炒），需调配麸炒品（A错），如僵蚕、白术、枳壳等。（3）处方直接写药名（或煅），需调配煅制品（C错），如花蕊石、钟乳石、自然铜、金礞石、青礞石、瓦楞子等。（4）处方直接写药名（或炒或炭），需调配炭制品（D错），如干漆、炮姜、地榆、侧柏叶、蒲黄等。（5）处方直接写药名（或炒），需调配清炒品（E错），如紫苏子、莱菔子、谷芽、麦芽、王不留行、酸枣仁、蔓荆子、苍耳子、牛蒡子、白芥子等。